为了使体育课更有利于儿童少年的生长发育，提高他们的体质健康水平，某校的体育老师决定进一步优化课程设计，使其更符合卫生方面的要求。在以下几点中，不合理的是
A. 整个课程分为开始部分、准备部分、基本部分、结東部分等四个基本环节
B. 一堂体育课中，实际运动练习的时间占全课时间的30%~40%
C. 准备活动的时间占据全课时间的10%
D. 结束部分，老师利用4分钟进行小结
E. 每节课上，对男生和女生有相同的运动量要求

正确答案：E。每节课上，对男生和女生有相同的运动量要求